关于肺动脉口正确的是
A. 是右心室的入口
B. 附近有冠状动脉的开口
C. 运送含氧量低的血液
D. 有三片三角形的瓣膜
E. 没有上述特征

正确答案：C。运送含氧量低的血液

解析：肺动脉口运送含氧量低的血液（C对）即右心室发出的肺动脉干及其分支输送静脉血。